患者，女，42岁，颈部弥漫性肿大，伴四肢困乏，气短，纳呆体瘦；舌苔薄，脉弱无力。治疗应首选
A. 仙方活命饮
B. 海藻玉壶汤
C. 四海舒郁丸
D. 柴胡疏肝散
E. 龙胆泻肝汤

正确答案：C。四海舒郁丸

解析：本题患者，女，42岁，颈部弥漫性肿大，伴四肢困乏，气短，纳呆体瘦；舌苔薄，脉弱无力治疗应首选四海舒郁丸（C对）。痰结血瘀当用海藻玉壶汤（B错）。仙方活命饮功用：清热解毒，消肿散结，活血止痛 主治：阳证痈疡肿毒初起（A错）。柴胡疏肝散功用：疏肝理气，活血止痛，主治：肝气郁滞证（D错）。龙胆泻肝汤功用泻肝胆火，清利湿热 主治：肝胆火热证（E错）。